丘系交叉部位在延髓的
A. 锥体交叉的下部
B. 锥体交叉的中部
C. 锥体交叉的上方
D. 橄榄中部
E. 橄榄上部

正确答案：C。锥体交叉的上方

解析：丘系交叉参与躯干和四肢非意识性本体感觉传导通路，其交叉部位在延髓的锥体交叉的上方（C对）。